可缓解鼻黏膜肿胀的肾上腺素α受体激动剂禁用于
A. 闭角型青光眼患者
B. 胃溃疡患者
C. 高脂血症患者
D. 甲状腺功能减退者
E. 慢性鼻炎患者

正确答案：A。闭角型青光眼患者

解析：本题考查药物的药理作用和使用禁忌。可缓解鼻黏膜肿胀的肾上腺素α受体激动剂禁用于闭角型青光眼（A对）。可缓解鼻黏膜肿胀的肾上腺素α受体激动剂是麻黄碱，麻黄碱会导致血压升高，可能会造成高眼压，对闭角型青光眼患者造成眼部损害。